能止咳平喘，润肠通便，但有小毒的药物是
A. 葶苈子
B. 杏仁
C. 白芥子
D. 黄药子
E. 苏子

正确答案：B。杏仁

解析：该题考查杏仁的药性及功效，属记忆内容。杏仁味苦，微温。有小毒，归肺、大肠经，其功效为止咳平喘，润肠通便（B对ACDE错）。